男性，20岁。活动后心悸、气急2月。检查发现肝大，质地中等，表面平滑有压痛，腹部移动性浊音阳性，下肢压陷性水肿。最可能的诊断是
A. 肝硬化腹水
B. 肝癌伴腹水
C. 肝结核伴结核性腹膜炎
D. 肾病综合征伴腹水
E. 右心衰竭、肝淤血伴腹水

正确答案：E。右心衰竭、肝淤血伴腹水

解析：患者活动后心悸气急，肝大，表面平滑有压痛，下肢压陷性水肿，均为右心衰竭的典型症状和体征。右心衰竭常伴肝淤血，严重肝淤血导致腹腔内血管床静水压增高，组织液回吸收减少而漏入腹腔，形成大量腹水，当腹腔内游离腹水在1000ml以上时，即可查出移动性浊音（九版诊断学P176），综上所诉，患者最可能的诊断是右心衰竭、肝淤血伴腹水（E对）。肝硬化（A错）失代偿期一般表现为肝功能减退和门脉高压；肝癌（B错）常表现为肝脏肿大，表面结节或肿块状；肝结核伴结核性腹膜炎（C错）患者多有低热、盗汗、腹痛等结核中毒症状；肾病综合征（D错）常有肾脏疾病病史，一般先有眼睑水肿，再有下肢水肿，且这四种疾病一般都不会出现活动后心悸气急等症状。